疫疠邪气的致病特点有
A. 发病急骤
B. 病情较重
C. 症状相似
D. 传染性强
E. 易于流行

正确答案：A、B、C、D、E。发病急骤；病情较重；症状相似；传染性强；易于流行